小儿肺炎喘嗽的好发年龄是
A. 3周岁以内
B. 3周岁～6周岁
C. 7周岁～9周岁
D. 10周岁～12周岁
E. 13周岁以上

正确答案：A。3周岁以内

解析：婴儿期为出生28天至一周岁，幼儿期为出生一周岁至三周岁，此阶段的小儿肺脏常虚，卫表不固，抵抗力较差，易受外邪侵袭而发为肺系疾病，故肺炎喘嗽好发于婴幼儿即是三周岁以内（A对）。3周岁～6周岁已为幼童期，抵抗力增强，肺系疾病发病率降低（B错）。7周岁～9周岁为及10周岁～12周岁为儿童期，疾病的种类及表现接近成人，水肿、哮喘常见（CD错）。13周岁以上为青春期或者成年期，好发疾病已基本和成人一致或已是成人表现（E错）。